老年患者不宜合用的药物有
A. 呋塞米和阿米卡星
B. 卡马西平和红霉素
C. 苯妥英钠与西咪替丁
D. 吲达帕胺与对乙酰氨基酚
E. 维生素C与葡萄糖酸钙

正确答案：A、B、C。呋塞米和阿米卡星；卡马西平和红霉素；苯妥英钠与西咪替丁